男，18岁。双下肢及颜面水肿1周。尿沉渣镜检：RBC0～2/HP，尿蛋白定量12.2g/d。血Alb18g/L，Scr79umol/L，ANA（-），乙型肝炎病毒标志物均（-）。如果经足量糖皮质激素治疗12周无效，其病理类型最可能是
A. 毛细血管内增生性肾小球肾炎
B. 微小病变型肾病
C. 膜性肾病
D. 膜增生性肾小球肾炎
E. 局灶节段性肾小球硬化

正确答案：D。膜增生性肾小球肾炎

解析：根据题干患者为肾病综合征表现，毛细血管内增生性肾小球肾炎（A错）表现为急性肾炎。患者经足量糖皮质激素治疗12周无效，说明该型对激素治疗的敏感性差，其病理类型最可能是膜增生性肾小球肾炎（D对），糖皮质激素及细胞毒药物治疗可能仅对该型部分儿童病例有效，成人疗效差，且本病男性多于女性，好发于青壮年，从该角度考虑，D选项可行较大。微小病变型肾病（B错）90%病例对糖皮质激素治疗有效。膜性肾病（C错）好发于于中老年人，青少年罕见。